患者，男性，18岁，先天性完全性腭裂4岁时行腭裂修复术，现腭前部牙槽突仍有裂隙与鼻腔相通，下前牙反牙合，上颌牙拥挤，面中部凹陷，面下部前突。腭裂修复术后，语音功能恢复正常的必要条件是
A. 软腭有长度
B. 患儿牙列完整，排列整齐
C. 悬雍垂外形良好
D. 发音时能形成良好的腭咽闭合
E. 患儿咽后壁上派氏嵴明显

正确答案：D。发音时能形成良好的腭咽闭合

解析：本题考查腭裂语音治疗。腭裂修复术后，语音功能恢复正常的必要条件是发音时能形成良好的腭咽闭合（D对）。发音时，因肌群的协调收缩，使软腭处于向上后延伸状态。软腭的中后1/3部分向咽后壁、咽侧壁靠拢；再由咽上缩肌活动配合，使口腔与鼻腔的通道部分瞬间隔开，形成“腭咽闭合”。正常发音时，软腭和咽上缩肌有节奏的运动、收缩，使气流有控制地进入口腔，再通过舌、唇、牙等器官的配合，能发出各种清晰的声音和言语。